药物经济学常用的研究方法有
A. 成本效果分析
B. 成本效益分析
C. 成本效用分析
D. 机会成本分析
E. 最小成本分析

正确答案：A、B、C、E。成本效果分析；成本效益分析；成本效用分析；最小成本分析